足厥阴肝经与足太阴脾经循行交叉，变换交叉的位置是在
A. 外踝上8寸处
B. 内踝上2寸处
C. 内踝上3寸处
D. 内踝上5寸处
E. 内踝上8寸处

正确答案：E。内踝上8寸处

解析：内踝上八寸处（E对）足厥阴肝经与足太阴脾经循行交叉，足三阴经内踝上8寸以下，厥阴在前、太阴在中间、少阴在后；内踝上8寸以上，太阴交出厥阴之前，其他部位均无交叉（ABCD错）。